为防止甲状舌管囊肿或瘘的术后复发，手术的关键是
A. 完整摘除囊肿
B. 追踪瘘管到舌骨表面结扎
C. 囊肿在舌骨表面剥离干净
D. 除囊肿或瘘管外一般应将舌骨中份一并切除
E. 以上都不正确

正确答案：D。除囊肿或瘘管外一般应将舌骨中份一并切除

解析：甲状舌管囊肿应手术切除囊肿或瘘管，而且应彻底，否则容易复发。手术的关键是，除囊肿或瘘管外一般应将舌骨中份一并切除。若仅切除囊肿或瘘管，由于舌骨中可能存在微细的副管，从而导致复发。掌握“甲状舌管囊肿及鳃裂囊肿”知识点。